2~3岁小儿常脉的脉动至数是
A. 一息五至
B. 一息四至以下
C. 一息六七至
D. 一息八九至
E. 一息十至

正确答案：C。一息六七至

解析：若按成人正常呼吸定息，2-3 岁的小儿，脉动6-7次为常脉，即每分钟 100 -120 次（C对）。